单纯疱疹病毒（HSV）1型的主要潜伏部位是
A. 口唇皮肤与黏膜
B. 三叉神经节
C. 唾液腺
D. 骶神经节
E. 脊髓后根神经节

正确答案：B。三叉神经节